久病咳喘，乏力少气，呼多吸少，自汗耳鸣，舌淡脉弱。其证候是
A. 肺肾气虚
B. 肺气虚
C. 脾肺气虚
D. 心肺气虚
E. 肾气不固

正确答案：A。肺肾气虚

解析：肺为气之主，肾为气之根，肺司呼吸，肾主纳气，久病肺肾气虚。肺气虚，呼吸功能减弱，则咳喘；宗气不足，卫表不固，则少气，自汗；肾气虚，不主摄纳，气不归原，则呼多吸少；耳窍失充，则耳鸣；气虚，机体功能减退，故乏力；舌淡脉弱为气虚之征，故久病咳喘，乏力少气，呼多吸少，自汗耳鸣，舌淡脉弱的证候为肺肾气虚证（又名肾不纳气证）（A对）。肺气虚（B错）证证候表现为面色淡白，少气懒言，语声低怯，神疲体倦，恶风等单纯的肺气虚。脾肺气虚（C错）证既有为久咳不止，气短而喘，咳声低微之肺气虚，亦有食欲不振，面白无华，神疲乏力，声低懒言，脉弱等脾气虚之表现。心肺气虚（D错）证既有心悸胸闷，气喘，动则尤甚之心气虚表现，又有神疲乏力，声低懒言，自汗，面色淡白，舌淡苔白等肺气虚表现。肾气不固（E错）证证候表现为腰膝酸软，神疲乏力，耳鸣耳聋；小便频数清长，夜尿频多。